某男，46岁。常年泄泻，大便时溏时泻，水谷不化，迁延反复，食少，食后脘闷不适稍进油腻之物则便次明显增多，面色萎黄肢倦乏力，舌淡苔薄白，脉细弱。中医辨证是
A. 湿热内蕴
B. 脾肾阳虚
C. 肝气乘脾
D. 食伤肠胃
E. 脾胃气虚

正确答案：E。脾胃气虚

解析：本题考查的是泄泻的辨证论治。常年泄泻，大便时溏时泻，水谷不化，迁延反复，食少，食后脘闷不适稍进油腻之物则便次明显增多，面色萎黄肢倦乏力，舌淡苔薄白，脉细弱。中医辨证是脾胃气虚（E对）。泄泻是以排便次数增多，粪质稀溏或完谷不化，甚至泻出如水样为主症的疾病。西医学的急性肠炎、肠易激综合征、炎症性肠病等有上述表现者，可参考此内容辨证论治。（一）寒湿内盛证：【症状】泄泻清稀，甚则如水样，脘闷食少，腹痛肠鸣，或兼见外感风寒，恶寒，发热，头痛，肢体酸痛。舌苔白或白腻，脉濡缓。（二）湿热伤中证（A错）：【症状】泄泻腹痛，泻下急迫，势如水注，或泻而不爽，粪色黄褐，气味臭秽，肛门灼热，烦热口渴，小便短黄。舌质红，苔黄腻，脉滑数或濡数。（三）食滞肠胃证（D错）：【症状】腹痛肠鸣，泻下粪便臭如败卵，泻后痛减，泻下伴有不消化食物，脘腹胀满，嗳腐吞酸，不思饮食。舌淡红，苔垢浊或厚腻，脉滑实。（四）肝气乘脾证（C错）：【症状】腹痛而泻，腹中雷鸣，攻窜作痛，矢气频作，每因抑郁恼怒或情绪紧张之时而泻，素有胸胁胀闷，嗳气食少。舌质淡，脉弦。（五）脾胃虚弱证：【症状】大便时溏时泻，迁延反复，食少，食后脘闷不舒，稍进油腻食物，则大便次数增多，面色萎黄，神疲倦怠。舌质淡，苔白，脉细弱。（六）肾阳虚衰证（B错）：【症状】黎明前脐腹作痛，肠鸣即泻，泻后则安，完谷不化，腹部喜暖，形寒肢冷，腰膝酸软。舌淡苔白，脉沉细。